半极性溶剂是
A. 水
B. 丙二醇
C. 甘油
D. 液体石蜡
E. 醋酸乙酯

正确答案：B。丙二醇